男，45岁。间断头晕1月余。1个月前在—次情绪激动后自觉头晕，休息后缓解，当时测血压150/95mmHg，自测血压有时增高，有时正常。建议采取的措施为
A. 进行低或中等强度的等张运动
B. 每日食盐量不少于6g
C. 膳食中脂肪量控制在总热量的50%以下
D. 体质指数控制在36kg/m²以内
E. 减少体育锻炼

正确答案：A。进行低或中等强度的等张运动

解析：中年男性患者，间断头晕，情绪激动后自觉头晕，休息后缓解，当时测血压高，自测血压有时增高，有时正常。该患者有高血压的征象，因此建议采取的措施为：进行低或中等强度的等张运动（A对），每日食盐量不超过6g（B错），体质指数控制在小于24kg/m²（D错），增加体育锻炼（E错），膳食中脂肪量控制在总热量的25%-30%（P736）（C错）。